女性，4岁半，因浮肿7天入院，查体：全身明显浮肿，尿少。入院前已10小时无尿，头晕。头痛，恶心呕吐，嗜睡，舌苔腻，脉沉弦，治疗首选方剂是
A. 龙胆泻肝汤
B. 真武汤合小半夏汤
C. 泻心汤
D. 温胆汤合附子泻心汤
E. 已椒苈黄丸合玉枢丹

正确答案：D。温胆汤合附子泻心汤

解析：该题主要考查急性肾炎的辩证以及方药。急性肾炎，是儿科常见的免疫反应性肾小球疾病，临床以急性起病，浮肿、少尿、血尿、蛋白尿及高血压为主要特征。水毒内闭证多见于病程早期，尿少尿闭为其突出证候，同时伴头晕头痛、恶心呕吐、嗜睡或昏迷等危重征象。该女性，4岁半，因浮肿7天入院，查体：全身明显浮肿，尿少。入院前已10小时无尿，头晕。头痛，恶心呕吐，嗜睡，舌苔腻，脉沉弦，可判断为肾炎水毒内闭，治法通腑泄浊，解毒利尿。方药温胆汤合附子泻心汤加减（D对）。龙胆泻肝汤合羚角钩藤汤治疗肾炎邪陷心肝（A错）。真武汤合小半夏汤、泻心汤不用于治疗小儿肾炎（BC错）。已椒苈黄丸合玉枢丹治疗急性肾炎水凌心肺证（E错）。